根据社区卫生服务中心设置指导标准，业务用房使用面积不应少于多少平方米
A. 200
B. 300
C. 400
D. 500
E. 600

正确答案：C。400